影响固定桥桥体挠曲变形的主要因素是
A. 桥体长度与厚度
B. 桥体结构形态
C. （牙合）力的大小
D. 桥体材料的性能
E. 以上均可

正确答案：C。（牙合）力的大小

解析：（牙合）力的大小：桥体的弯曲变形是在（牙合）力的作用下发生的，（牙合）力是桥体发生弯曲形变的主要原因。掌握“固定桥的设计”知识点。